生物医学模式的贡献在于
A. 重视人的社会性
B. 重视人们心理活动的复杂性
C. 抗菌药物的应用、发展了基因理论等
D. 能够圆满解释当今人类面临的所有健康问题
E. 以上均是

正确答案：C。抗菌药物的应用、发展了基因理论等